肩关节脱位常见的方位是
A. 上方
B. 后方
C. 前上方
D. 下方
E. 后上方

正确答案：D。下方

解析：肩关节关节囊上方有喙肱韧带加强，前壁和后壁有很多肌腱，唯有下壁最为薄弱，所以肩关节常常朝下方（D对）脱出。